男，72岁。乏力、走路不稳3个月。查体：肌张力减低，共济失调，意向性震颤，指鼻试验阳性。该患者最可能的病变部位是
A. 小脑
B. 皮层运动区
C. 脑干
D. 基底神经节
E. 脊髓

正确答案：A。小脑

解析：患者老年男性，乏力、走路不稳3个月（躯体平衡异常）。查体：肌张力减低，共济失调，意向性震颤，指鼻试验阳性（小脑性共济失调表现），根据上述表现患者最可能的病变部位是小脑（A对）。大脑皮层运动区（B错）病变多表现为单瘫或不均等偏瘫。脑干损伤（P14）表现为交叉性瘫痪。基底神经节损伤（D错）（P10）主要产生运动异常和肌张力改变。脊髓（E错）（P19）损伤表现为损伤平面以下的感觉运动障碍。